与碳酸钙、氧化镁等制剂同服可形成络合物，影响其吸收的药物有
A. 卡那霉素
B. 左氧氟沙星
C. 红霉素
D. 美他环素
E. 多西环素

正确答案：B、D、E。左氧氟沙星；美他环素；多西环素

解析：本题考查四环素类和喹诺酮类抗菌药物。与碳酸钙、氧化镁等制剂同服可形成络合物，影响其吸收的药物有左氧氟沙星（B对）、美他环素（D对）、多西环素（E对）。四环素类（如美他环素、多西环素）和喹诺酮类（如左氧氟沙星）抗菌药物都容易与钙剂，镁剂等金属离子螯合成络合物。卡那霉素（A错）为氨基糖苷类抗生素。红霉素（C错）为大环内酯类抗生素。